全口义齿修复哪一个部位不需要缓冲
A. 下颌隆突
B. 腭隆突
C. 翼上颌切迹
D. 切牙乳头
E. 上颌硬区

正确答案：C。翼上颌切迹

解析：缓冲区：无牙颌的骨性隆突部位，如上颌隆突、颧突、上颌结节的颊侧、下颌隆突、下颌舌骨嵴以及牙槽嵴上的骨尖、骨棱等部位，表面被覆黏膜较薄，切牙乳突内有神经和血管。这些部位均不能承受咀嚼压力，全口义齿基托组织面在上述的相应部位应做缓冲处理，以免因压迫导致疼痛，或形成支点而影响义齿的稳定。翼上颌切迹：在上颌结节之后，为蝶骨翼突与上颌结节后缘之间的骨间隙。表面有黏膜覆盖，形成软组织凹陷。为上颌全口义齿后缘的界限。不属于缓冲部位。掌握“无牙颌的解剖标志及功能分区”知识点。